治愈后，遗留有萎缩性瘢痕的皮肤病是
A. 白秃疮
B. 肥疮
C. 鹅掌风
D. 疥疮
E. 白疕

正确答案：B。肥疮

解析：肥疮，相当于西医的黄癣，有传染性，多见于儿童，其特点是初起红色丘疹，后有脓疱，干后结痂，颜色蜡黄，形成黄癣痂，扩大融合成片，可散发似鼠屎的臭味，自觉瘙痒，头发干燥，失去光泽，病变先从头顶部开始，逐渐向四周扩大，可侵及整个头皮，当病变痊愈后，则在头皮留下广泛、光滑的有萎缩性瘢痕（B对）。白秃疮，相当于西医的白癣，其皮损特征为在头皮有圆形或不规则的覆盖灰白鳞屑的斑片，本病青春期可自愈，秃发也能再生，不遗留疤痕（A错）。鹅掌风，相当于西医的手癣，皮损特点是：初起为掌心或指缝水疱或掌部皮肤角化脱屑、水疱，水疱多透明如晶，散在或簇集，瘙痒难忍，水疱破后干涸，叠起白屑，中心向愈，四周继发疱疹，并可延及背或腕部，本病病程为慢性，反复发作，治愈后不会遗留有萎缩性瘢痕（C错）。疥疮，是由疥虫寄生在人体皮肤所引起的一种接触传染性皮肤病，其特点是夜间剧痒，在皮损处有灰白色、浅黑色或普通皮色的隧道，可找到疥虫，本病具有传染性，治愈后不会遗留有萎缩性瘢痕（D错）。白疕，因其‘肤如疹疥，色白而痒，搔起皮疹’而得名，是一种常见的易于复发的炎症性皮肤病，相当于西医的银屑病，其特点是：在红斑上有松散的银白色鳞屑，抓之有薄膜及露水珠样出血点，治愈后不会遗留有萎缩性瘢痕（E错）。